下列酸碱指示剂中在酸性区域变色的有
A. 溴甲酚绿
B. 甲基橙
C. 甲基红
D. 酚酞
E. 百里酚酞

正确答案：A、B、C。溴甲酚绿；甲基橙；甲基红

解析：本题考查酸碱滴定法。在酸性区域变色的有溴甲酚绿（A对）、甲基橙（B对）、甲基红（C对）。溴甲酚绿的变色范围为3.8～5.4，甲基橙的变色范围为3.1～4.4，甲基红的变色范围为4.4～6.2。酚酞（D错）的变色范围为8.0～10.0，百里酚酞（E错）的变色范围为9.4～10.6。